发病率适用于
A. 慢性病
B. 疾病的长期流行
C. 易于确切指出发病时间的急性病
D. 某病的隐性感染
E. 以上都不对

正确答案：C。易于确切指出发病时间的急性病